单端固定桥的适应证，哪项是错误的
A. 基牙牙周健康
B. 基牙有良好的固位
C. 缺隙小
D. （牙合）力小
E. 为了少磨牙

正确答案：E。为了少磨牙

解析：本题考查固定桥的组成和分类。为了少磨牙（E错，为本题正确答案）不是单端固定桥的适应证。单端固定桥在临床上应严格选择病例，如缺牙间隙小（C对），承受（牙合）力不大（D对），而基牙牙周健康（A对）又有足够的支持力和固位力（B对），桥体设计合理，仍可采用。